小儿在方药施养中，下列哪项应禁忌
A. 顾护脾胃
B. 用药轻巧
C. 慎用大辛大热
D. 药食相当
E. 体虚即可大补

正确答案：E。体虚即可大补

解析：由于小孩尚处于“稚阴稚阳”之体，虽然“虚则补之”，但事实上小儿的身体并不虚，而是本身生长发育较快，且补益的食材会阻碍脾胃，过多食用可导致消化不良（E错，为本题正确答案）。脾为后天之本，脾属土，乃万物之基，无论生病与否，保护脾胃，均当应为小儿调养的第一要务（A对）。小儿身体虽稚嫩，发育尚未成熟，大多数婴儿与生俱来的拥有一定的生存本能来对抗各种疾病邪气，即使偶有小恙，只需以药食稍加辅助即可。所以小儿用药必应轻巧，这是小儿用药的第一原则（B对）。大寒、大辛等性味过于猛烈的药物，功效较强，如若使用不当，很可能伤及小孩五脏六腑的阴阳，给孩子造成一些不可逆的伤害（C对）。药食同源的食物既是我们平常吃喝的饮食之物，又是调理我们身体的治病良药，对小儿健康不会造成太大伤害（E错，为本题正确答案）。